以下对生态学研究错误的说法是
A. 也叫相关性研究
B. 以个体为观察、分析单位
C. 生态学谬误不可以避免
D. 评估人群干预措施的效果

正确答案：B。以个体为观察、分析单位

解析：本题考查生态学研究的相关概念。生态学研究又称相关性研究（A对），是描述性研究的一种类型，它是在群体（B错，为本题正确答案）的水平上研究某种暴露因素与疾病之间的关系，以群体为观察和分析的单位。生态学谬误是生态学研究的最主要缺陷，同时生态学谬误在生态学研究中常难以避免（C对）。生态学研究的作用包括：①提供病因线索，产生病因假设；②评估人群干预措施的效果（D对）。